流行性出血热早期休克的原因是
A. 过敏性
B. 失血浆性
C. 出血性
D. 感染性
E. 心源性

正确答案：B。失血浆性

解析：流行性出血热早期休克（原发性休克）的原因是血管扩张、血管通透性增加，血浆外渗（B对），血容量下降；同时血浆外渗会导致血液浓缩，促进DIC的发生，导致血液循环淤滞，因而使有效循环血量进一步降低，加剧休克症状。出血（C错）是本病晚期休克（继发性休克）的主要原因。